治疗温热病后，神倦瘛疭，舌绎虚弱者，应首选
A. 羚角钩藤汤
B. 天麻钩藤饮
C. 地黄饮子
D. 大定风珠
E. 镇肝熄风汤

正确答案：D。大定风珠

解析：治疗温热病后，神倦瘛疭，舌绎虚弱者。方用大定风珠，治温病后期，真阴大亏，虚风内动之常用方。鸡子黄、阿胶为血肉有情之品，滋阴养血，以息虚风；白芍、生地、麦冬滋阴柔肝；龟板、鳖甲、牡蛎滋阴潜阳，重镇息风；麻仁养阴润燥；五味子收敛真阴；炙甘草调和诸药（D对）。羚角钩藤汤为治疗肝经热盛动风的常用方（A错）。天麻钩藤饮为治疗肝阳偏亢，肝风上扰的常用方（B错）。地黄饮子为治疗肾虚喑痱的常用方（C错）。镇肝息风汤为治疗类中风之常用方（E错）。